按分散系统分类，碘甘油属液体制剂的类型是
A. 溶胶剂
B. 高分子溶液剂
C. 乳剂
D. 混悬剂
E. 低分子溶液剂

正确答案：E。低分子溶液剂

解析：本题考查的是溶液剂的分类。按分散系统分类，碘甘油属液体制剂的类型是低分子溶液剂（E对）。碘甘油属于甘油剂。低分子溶液剂：系指小分子药物以分子或离子状态分散在溶剂中形成的均相液体制剂。所形成的分散体系均匀、透明并能通过半透膜，可供内服或外用。常用的有溶液剂、芳香水剂、甘油剂、醑剂等。甘油剂：系指药物溶解于甘油中制成的专供外用的溶液剂，常用于口腔、耳鼻喉科疾病。碘甘油：【注解】碘在甘油中的溶解度约为1.0%，加入碘化钾与碘形成可溶性络合物而助溶，并可提高碘的稳定性。甘油作为碘的溶剂可缓和碘对黏膜的刺激性，甘油可使药物滞留皮肤、黏膜而延长疗效。本品临床应用时不宜用水稀释，以免增加刺激性。溶胶剂（A错）系指固体药物以多分子聚集体分散于水中形成的非均相的液体制剂，亦称疏水胶体溶液。高分子溶液剂（B错）系指高分子化合物溶解于溶剂中制成的均匀分散的液体制剂，属于热力学稳定体系。乳剂（C错）系指两种互不相溶的液体，经乳化制成的一种液体以液滴状态分散于另一相液体中形成的非均相分散体系的液体制剂。混悬剂（D错）系指难溶性固体药物以微粒状态分散于分散介质中形成的非均相的液体制剂，也包括干混悬剂。